下列哪项不是卫生部规定的卫生标准
A. 每1ml饮用水细菌总数不得超过100个
B. 每100ml汽水大肠菌群不得超过5个
C. 每1000ml饮用水大肠菌群不得超过3小
D. 每1ml饮料细菌总数不得超过100个
E. 每100ml果汁大肠菌群不得超过100个

正确答案：E。每100ml果汁大肠菌群不得超过100个

解析：中国饮用水的卫生标准（GB5749-2006）规定，在100ml饮用水中不得检出大肠菌群，1ml饮用水中细菌总数不得超过100个菌落形成单位（CFU）。掌握“肠道杆菌共性及埃希氏菌属”知识点。